腹部手术后能进食的主要依据是
A. 胃管抽出澄清胃液
B. 病人己下床活动
C. 病人有明显饥饿感
D. 肠鸣音增强
E. 肛门排气后

正确答案：E。肛门排气后

解析：肛门排气后（E对）说明肠蠕动恢复、肠道通畅（进食的两个前提），可作为腹部手术后能进食的主要依据。胃管抽出澄清胃液（A错）仅说明胃中没有出血及淤血或食物瘀滞。病人下床活动（B错）与肠道功能没有直接联系。长期未进食，病人一般均有明显饥饿感（C错）。肠鸣音增强（D错）提示肠道蠕动增强，在机械性肠梗阻亦可出现。